维生素缺乏性佝偻病的主要病机是
A. 肝肾不足
B. 心肾两虚
C. 肺脾不足
D. 心肝火旺
E. 脾肾两虚

正确答案：E。脾肾两虚

解析：维生素缺乏性佝偻病的主要病机是脾肾两虚，肾为先天之本，主骨生髓，齿为骨之余，髓之所养也，故先天肾气不足，则骨髓不充，骨失所养，则出现颅骨软化、囟门迟闭、齿迟，甚至骨骼畸形等。脾为后天之本，气血生化之源，若喂养失宜，或饮食失调，则可导致脾失健运，水谷精微输布无权，久之全身脏腑失于濡养（E对）。